回收的问卷份数与发出的份数的比率称为
A. 问卷设计
B. 问卷调查
C. 问卷的信度
D. 问卷效度
E. 问卷回收率

正确答案：E。问卷回收率

解析：通常所说的问卷回收率是回收的问卷份数与发出的份数的比率。回收率是反映问卷调查质量的一个重要指标。掌握“口腔健康问卷调查”知识点。